关于药品包装、标签、说明书的说法，正确的是
A. 药品标签中的有效期应当标注到日，按照年、月、日的顺序标注
B. 药品内标签是指药品外包装以内的包装标签，至少应当标注药品通用名称、规格、产品批号、有效期等内容
C. 仅处方药说明书中要求有【孕妇及哺乳期妇女用药】【儿童用药】【老年用药】【临床试验】【药理毒理】项目
D. 药品的最小销售单元包装属于内包装，必须按照规定印有或者贴有标签附有说明书

正确答案：C。仅处方药说明书中要求有【孕妇及哺乳期妇女用药】【儿童用药】【老年用药】【临床试验】【药理毒理】项目

解析：本题考查药品说明书的格式、内容和书写要求。15.【孕妇及哺乳期妇女用药】 （仅处方药有此项）16.【儿童用药】 （仅处方药有此项）17.【老年用药】 （仅处方药有此项）20.【临床试验】 （仅处方药具有）21.【药理毒理】（仅处方药具有）（C对）。药品标签中的有效期应当按照年、月、日的顺序标注，年份用四位数字表示，月、日各用两位数表示（A错）。药品内标签指直接接触药品包装的标签（B错），外标签指内标签以外其他包装的标签。最小销售单元包装实际上也是属于外包装（D错），药品的每个最小销售单元的包装必须按照规定印有或贴有标签并附有说明书。